义齿初戴时出现痛的原因，除了
A. 组织面有小瘤
B. 有个别牙早接触
C. 印模变形
D. 石膏模型损伤
E. 垂直距离过短

正确答案：E。垂直距离过短

解析：本题考查义齿初戴时出现痛的原因。垂直距离过高会引起下颌牙槽嵴普遍疼痛或压痛，垂直距离过短（E错，为本题的正确答案）不会引起疼痛。组织面有小瘤（A对），会压迫黏膜组织产生压痛。有个别牙早接触（B对）会产生过大（牙合）力产生疼痛。印模变形（C对）或石膏模型损伤（D对）则制作的最终义齿会与患者口腔不密合，出现小瘤压迫黏膜组织产生压痛。